下列流感实验室检查结果，不符合单纯型流感的是
A. 白细胞总数减少
B. 中性粒细胞数减少
C. 淋巴细胞数相对增加
D. 血小板减少
E. 单核细胞数正常

正确答案：D。血小板减少

解析：单纯型流感血白细胞总数正常或偏低（A对），淋巴细胞相对增加（C对），中性粒细胞数减少（B对），单核细胞数正常（E对）（D错，为本题正确答案）。